当低温、缺氧或代谢障碍等因素影响Na⁺-K⁺泵活动时，可使细胞的
A. 静息电位增大，动作电位幅度减小
B. 静息电位减小，动作电位幅度增大
C. 静息电位增大，动作电位幅度增大
D. 静息电位减小，动作电位幅度减小
E. 静息电位和动作电位幅度均不变

正确答案：D。静息电位减小，动作电位幅度减小